我国规定，高组胺鱼类的组胺含量不得超过
A. 50mg/100g
B. 40mg/100g
C. 30mg/100g
D. 20mg/100g
E. 10mg/100g

正确答案：B。40mg/100g

解析：本题考查我国规定的高组胺鱼类的组胺含量。我国规定，高组胺鱼类的组胺含量不得超过40mg/100g（B对ACDE错）。